表示接受治疗的患者中治愈的频率的是
A. 发病率
B. 患病率
C. 某病病死率
D. 某病死亡率
E. 治愈率

正确答案：E。治愈率